对磺胺类药物有严重过敏史的患者可选择的利尿剂是
A. 布美他尼
B. 依他尼酸
C. 呋塞米
D. 托拉塞米
E. 吲达帕胺

正确答案：B。依他尼酸

解析：本题考查依他尼酸。对磺胺类药物有严重过敏史的患者可选择的利尿剂是依他尼酸（B对）。依他尼酸是一个非磺酰胺衍生物的袢利尿剂，与其他袢利尿剂比较耳毒性更大，因此临床使用受到限制，主要用作对磺酰胺类药物过敏或不耐受患者的替代药物。呋塞米（C错）、布美他尼（A错）、托拉塞米（D错）和吲达帕胺（E错）的化学结构中都含有磺酰胺（脲）基团，禁用于对磺胺药过敏者。